男性矿工，井下作业时发生塌方砸伤背部，当即倒于地上，下肢无力不能行走，立即来诊。检查见胸腰段后凸畸形并压痛，双下肢不全瘫。感觉异常平面位于双侧腹股沟水平。为明确诊断应首选的辅助检查是
A. 肌电图
B. X线片
C. CT
D. MRI
E. B超

正确答案：D。MRI

解析：患者背部砸伤后，胸腰段后凸畸形和压痛（胸腰椎椎骨骨折典型体征），双下肢不全瘫、双侧腹股沟水平感觉异常（T12节段脊髓受损表现）（脊髓受损的定位标准：胸骨角平T2，双乳头平T4，剑突平T6，肋弓平T8，脐平T10，腹股沟平T12），结合患者病史、临床表现及体查，该患者最可能的诊断为胸腰段脊柱骨折伴脊髓损伤，为明确诊断应首选的辅助检查是MRI（D对），MRI可清晰地显示出脊髓受损范围、受损程度及脊髓受压情况等。肌电图（P733）（A错）主要用于神经肌肉功能损伤程度的诊断，但对于全面了解脊髓损伤的情况意义不大。X线片（P689）（B错）、CT（P689）（C错）可以显示椎骨是否存在骨折，但均无法显示脊髓损伤情况。B超（E错）对于了解脊髓损伤的情况意义不大。